甲是药品零售连锁企业，下辖300余家直营门店，经营类别为处方药、甲类非处方药、乙类非处方药；经营范围为中药饮片、化学药、生物制品、中成药。甲有自建网站，2011年取得《互联网药品信息服务资格证书》，2012年取得《互联网药品交易服务资格证书》，获准通过自建网站开展网络药品销售活动。甲的下列药品网络销售行为中违反法律规定的是
A. 甲自建网站展示销售药品的通用名称，并在页面留下咨询电话
B. 某消费者从甲自建网站下单购买了1盒非处方药培菲康，在选定的门店取药
C. 某消费者从甲自建网站下单购买了3盒红霉素眼膏，由甲所属门店的执业药师递送至该消费者家中
D. 甲通过自建网站，根据消费者提供的处方为其调配处方药安定，并将该药品递送至该消费者家中

正确答案：D。甲通过自建网站，根据消费者提供的处方为其调配处方药安定，并将该药品递送至该消费者家中

解析：本题考查的是网络药品经营管理。甲是药品零售连锁企业，下辖300余家直营门店，经营类别为处方药、甲类非处方药、乙类非处方药；经营范围为中药饮片、化学药、生物制品、中成药。甲有自建网站，2011年取得《互联网药品信息服务资格证书》，2012年取得《互联网药品交易服务资格证书》，获准通过自建网站开展网络药品销售活动。甲的下列药品网络销售行为中违反法律规定的是甲通过自建网站，根据消费者提供的处方为其调配处方药安定，并将该药品递送至该消费者家中（D错，为本题正确答案）。2019年8月新修订《药品管理法》规定，药品上市许可持有人、药品经营企业通过网络销售药品，应当遵守《药品管理法》中药品经营的有关规定；具体管理办法由国家药品监督管理局会同国务院卫生健康主管部门等部门制定；疫苗、血液制品、麻醉药品、精神药品、医疗用毒性药品、放射性药品、药品类易制毒化学品等国家实行特殊管理的药品不得在网上销售。同时，新修订《药品管理法》还规定网络药品交易第三方平台提供者应当按照国家药品监督管理局的规定，向所在地省级药品监督管理部门备案。新的网络药品经营监管体系正在逐步构建形成。网络药品交易服务的线上与线下联动模式，Online to Offline（O-to-O）：（1）“网订店取”，个人消费者通过网络下单购买药品，赴就近的药品零售企业经营场所获取药品和相关药学服务（B对）。（2）“网订店送”，个人消费者通过网络下单购买药品，由药品零售企业的执业药师或其他药学技术人员按照药品GSP配送药品的要求，将购买的药品送递至个人消费者，并当面向其提供相关药学服务（C对）。国家鼓励药品零售企业向个人消费者提供“网订店取”“网订店送”模式的网络药品交易服务。药品网络销售者应当在网站首页或者经营活动的主页面醒目位置清晰展示相关资质证明文件、备案凭证和企业联系方式（A对），并将展示的证书信息链接至国家药品监督管理局网站对应的数据查询页面。证书发生变更的，应当及时更新网站展示信息。